双肺满布湿啰音见于
A. 支气管哮喘
B. 支气管扩张
C. 肺结核
D. 急性肺水肿
E. 支气管肺炎

正确答案：D。急性肺水肿

解析：湿啰音是由于吸气时气体通过呼吸道内的分泌物形成的水泡破裂所产生的声音。急性肺水肿（D对）时，肺间质液体集聚过多并侵入肺泡，肺含水量增加，双肺布满湿啰音。支气管扩张（B错）、肺结核（C错）和支气管肺炎（E错）产生的都是局部湿啰音，严重支气管肺炎时，双肺也可布满湿啰音。支气管哮喘（A错）发作时典型的体征是双肺可闻及广泛的哮鸣音，哮鸣音属于干啰音。